属于炎症性囊肿，肉眼见囊壁厚薄不一，囊肿较小时可随拔除之残根或患牙一起完整摘除，为附着于患牙根尖部的软组织囊性肿物，为哪种疾病的表现
A. 鼻腭管囊肿
B. 黏液囊肿
C. 含牙囊肿
D. 根尖囊肿
E. 多形性腺瘤

正确答案：D。根尖囊肿

解析：根尖周囊肿是颌骨内最常见的牙源性囊肿，属于炎症性囊肿，肉眼见囊肿大小和囊壁厚薄不一，囊肿较小时可随拔除之残根或患牙一起完整摘除，为附着于患牙根尖部的软组织囊性肿物。掌握“牙源性囊肿”知识点。